上皮表层水肿，角化层内有中性粒细胞浸润，常形成微小脓肿，且在上皮表面能够检查出菌丝的是
A. 结节病
B. 念珠菌病
C. 疱疹性口炎
D. 多形性红斑
E. 白塞综合征

正确答案：B。念珠菌病

解析：念珠菌侵入组织，引起上皮表层水肿，角化层内有中性粒细胞浸润，常形成微小脓肿。上皮棘层增生，在角化层或上皮的外1/3处可见菌丝。掌握“口腔念珠菌病与肉芽肿性唇炎”知识点。